起效较慢，服用3个月才可以改善由前列腺增生导致的尿路梗阻，减少残余尿量的5-α还原酶抑制剂是
A. 非那雄胺
B. 阿呋唑嗪
C. 特拉唑嗪
D. 氟伏沙明
E. 度他雄胺

正确答案：A。非那雄胺

解析：本题考查抗高血压增生症药。起效较慢，服用3个月才可以改善由前列腺增生导致的尿路梗阻，减少残余尿量的5-α还原酶抑制剂是非那雄胺（A对）。非那雄胺和依立雄胺起效缓慢，见效时间为3～6个月，对前列腺增生症状严重者、尿流率严重减慢者、残余尿量较多者不宜选用，推荐应用度他雄胺（E错）。后者显效快，服用1个月内即能缓解症状，造成此种显著差异是度他雄胺具有双重作用，可同时阻断1型和2型两种5α还原同工酶。阿呋唑嗪（B错）、特拉唑嗪（C错）属于α₁受体阻断剂。氟伏沙明（D错）为选择性5-HT再摄取抑制剂类抗抑郁药。